核酸分子中百分比含量相对恒定的元素是
A. 碳（C）
B. 氢（H ）
C. 氧（O）
D. 氮（ N ）
E. 磷（P）

正确答案：E。磷（P）

解析：本题考查核酸。核酸分子中百分比含量相对恒定的元素是磷（P）（E对）。核酸分子中百分比含量相对恒定的元素是磷（P）；而蛋白质中恒定的是氮（N）（D错），各种蛋白质的含氮量很接近，平均为16%。